血管瘤消退完成期一般在
A. 1～3岁
B. 3～5岁
C. 4～6岁
D. 5～8岁
E. 10～12岁

正确答案：E。10～12岁

解析：本题考查血管瘤与脉管畸形。血管瘤消退完成期：一般在10～12岁（E对）。大面积的血管瘤完全消退后可以后遗局部色素沉着，浅瘢痕，皮肤萎缩下垂等体征。据统计，约50% ~ 60%的患者在5年内完全消退:75%在7年内消退完毕;约10% ~ 30%的患者可持续消退至10岁左右，但可为不完全消退。因此所谓消退完成期一般在10 ~ 12岁。